对于社区诊断描述正确的是
A. 个体水平上的疾病判断
B. 依据的是症状、体征和实验室检查结果
C. 理论基础是临床专业知识
D. 通常采用的是流行病学方法
E. 是一种在疾病发生后的诊断

正确答案：D。通常采用的是流行病学方法

解析：社区诊断是指社区卫生工作者通过一定的定性与定量的调查研究方法，收集必要的资料，通过科学、客观地分析确定并得到社区人群认可的该社区主要的公共卫生问题及社区现有资源状况，为社区预防服务计划的制订提供科学依据。社区诊断是通过定期系统地收集、整理、分析社区的健康信息，包括反映健康状况的统计学资料，社区卫生需求以及有关健康问题的流行病学和其他研究的资料作出的。由此可知，对于社区诊断描述正确的是通常采用的是流行病学方法（D对），个体水平上的疾病判断（A错）、依据的是症状体征和实验室检查结果（B错）、理论基础是临床专业知识（C错）、是一种在疾病发生后的诊断（E错）均为描述临床诊断的内容。